慢性根尖周脓肿的镜下表现描述错误的一项是
A. 肉芽肿中央细胞液化、坏死，形成脓液
B. 可由急性牙槽脓肿转变来
C. 周围主要是中性粒细胞、巨噬细胞
D. 有胆固醇晶体和含铁血黄素沉积
E. 在邻近的牙周膜和骨髓腔内也可见血管扩张，炎细胞浸润

正确答案：D。有胆固醇晶体和含铁血黄素沉积

解析：本题考查急慢性根尖周炎。慢性根尖周脓肿的镜下表现描述错误的是有胆固醇晶体和含铁血黄素沉积（D错，为本题正确答案），慢性根尖周肉芽肿部分病例可见此现象。慢性根尖周脓肿的病理变化：肉眼观察拔下的患牙根尖区有污秽的脓性分泌物沉积，根尖粗糙不平。镜下观察可见肉芽肿中央的细胞坏死、液化，形成脓液（A对），周围主要是中性粒细胞、巨噬细胞（C对），外有密集的淋巴细胞和浆细胞浸润。若由急性牙槽脓肿转变来（B对），根尖部贮存的脓液被周围的纤维结缔组织包绕，和肉芽肿中心液化所形成的脓肿相同。根尖部骨组织和牙骨质可有吸收破坏。在邻近的牙周膜和骨髓腔内也可见血管扩张，炎细胞浸润（E对）。